空气质量指数为101～200时,空气质量状况为轻度污染，相应的表征颜色为
A. 橘红
B. 浅黄
C. 墨绿
D. 天蓝
E. 紫红

正确答案：A。橘红

解析：本题考查空气污染指数表示颜色。根据表12-5，当空气质量指数为101～200时，空气质量状况为轻度污染，相应的表征颜色为橙红色（A对BCDE错）。